对于逆行性牙髓炎，临床检查的叙述不正确的一项是
A. 患牙没有引发牙髓炎的牙体硬组织疾病
B. 患牙有严重的牙周炎表现
C. 患牙有严重的龈袋
D. 牙齿不同程度的松动
E. 牙周袋溢脓

正确答案：C。患牙有严重的龈袋

解析：逆行性牙髓炎临床检查：患牙没有可引发牙髓炎的牙体硬组织疾病。患牙有严重的牙周炎表现，如深达根尖区或根分叉的牙周袋、牙龈水肿充血、牙周袋溢脓；牙齿不同程度的松动；叩诊轻度疼痛（+）～中度疼痛（++），叩诊浊音；X线片显示广泛的牙周组织破坏或根分叉病变。掌握“残髓炎及逆行性牙髓炎”知识点。